某男，10岁。近2日发热，咽痛，时咳，腹泻，一日5～6次。家长的朋友根据个人育儿经验，推荐治疗腹泻可用双歧杆菌三联活菌胶囊，发热、咽痛、时咳可用中药方金银花、连翘、鱼腥草、黄芩、甘草。家长遂去药店咨询，执业药师告知，服用双歧杆菌三联活菌胶囊，应避免同时使用的中药有
A. 金银花
B. 连翘
C. 鱼腥草
D. 甘草
E. 黄芩

正确答案：A、B、C、E。金银花；连翘；鱼腥草；黄芩

解析：本题考查的是中西药不合理联用的例举。某男，10岁。近2日发热，咽痛，时咳，腹泻，一日5～6次。家长的朋友根据个人育儿经验，推荐治疗腹泻可用双歧杆菌三联活菌胶囊，发热、咽痛、时咳可用中药方金银花、连翘、鱼腥草、黄芩、甘草）。家长遂去药店咨询，执业药师告知，服用双歧杆菌三联活菌胶囊，应避免同时使用的中药有金银花（A对）、连翘（B对）、鱼腥草（C对）与黄芩（E对）。金银花、连翘、黄芩、鱼腥草等及其中成药，不宜与菌类制剂如乳酶生、促菌生等联用，因金银花、连翘、黄芩、鱼腥草等及其中成药具有较强抗菌作用，服用后在抗菌的同时，还能抑制或降低西药菌类制剂的活性。甘草（D错）具有糖皮质激素样作用，有水钠潴留和排钾效应，还能促进糖原异生，加速蛋白质和脂肪的分解，使甘油、乳酸等各种糖、氨基酸转化成葡萄糖，使血糖升高，从而减弱胰岛素、甲苯磺丁脲、格列本脲等降糖药的药效。因此含有甘草的中成药，不能与磺酰脲类降糖药联用。